男，55岁。10年前诊断为肝炎肝硬化，3年前行门腔静脉分流术；2天前出现睡眠倒错、计算能力下降。该患者不宜进食的食物种类是
A. 淀粉类食物
B. 低脂饮食
C. 高维生素食物
D. 高纤维素食物
E. 高蛋白饮食

正确答案：E。高蛋白饮食

解析：患者中年男性，肝炎肝硬化病史，3年前行门腔静脉分流术（广泛门-体侧支循环形成，肝性脑病的诱因），2天前出现睡眠倒错、计算能力下降（肝性脑病症状）。（根据患者的病史、临床表现，可以诊断为肝炎肝硬化、门腔静脉分流术后、肝性脑病，肝性脑病门-体分流对蛋白不能耐受者，应避免大量蛋白饮食，该患者不宜进食的食物种类是高蛋白饮食（E对）。肝性脑病患者在去除诱因同时应给予营养支持，以促进机体的合成代谢，抑制分解代谢，保持正氮平衡，同时，应尽量保证热量供应和各种维生素的补充，酌情输注血浆或者白蛋白。淀粉类、低脂食物有利于提供充足热量（AB对），高维生素食物（C对）可以补充维生素。高纤维素食物（D对）所含非吸收性纤维被肠菌酵解产酸有利于氨的排出。